MMPI属于一种
A. 智力测验
B. 人格测验
C. 评定量表
D. 投射测验
E. 神经心理测验

正确答案：B。人格测验

解析：明尼苏达多项人格调查表（MMPI）自问世以来，应用非常广泛，为美国出版的《心理测验年鉴》第9版 （1985年）中最常用的人格量表（B对）。MMPI主要用于病理心理研究，协助临床诊断，在精神医学、心身医学、行为医学、司法鉴定等领域应用十分广泛。MMPI适用于16岁以上、至少有6年教育年限者。智力测验（A错）主要应用于儿童智力发育的鉴定以及作为脑器质性损害及退行性病变的参考指标，此外也可作为特殊教育或职业选择时的咨询参考。常用的工具有比奈-西蒙智力量表、韦克斯勒成人和儿童智力量表、丹佛发育筛选测验（DDST）等。神经心理学测验（E错）可用于脑器质性损害的辅助诊断和脑与行为关系的研究，主要包括一些个别能力测验，如感知运动测验、记忆测验、联想思维测验等，还有一些成套测验，主要以H-R神经心理学测验为代表。目前在临床和心理卫生工作中，还应用一些评价精神症状及其他方面的评定量表（C错），如抑郁量表、焦虑量表、生活事件量表、认知功能量表、生活质量综合评定量表、心身健康调查表等，这些量表对临床工作以及科研等具有特殊的意义和应用价值。投射测验（D错）是指采用某种方法绕过受访者的心理防御，在他们不防备的情况下探测其真实想法。